“逆传心包”是指
A. 由肺传入心包
B. 由肺传入营分
C. 由肺卫传入心包
D. 由肺卫传入营分
E. 由气分传入营分

正确答案：C。由肺卫传入心包

解析：逆传心包指温病传变的另一规律。一般温病的传变规律是由卫经气，营到血，如果病邪较重，发病开始就严重，变化迅速的，可不按次序传变，由卫分（肺）突然陷入营分（心包），出现神昏谵语等中枢神经症状，称为逆传心包（C对）。